大气污染物碳氢化合物与氮氧化物对环境的主要影响是
A. 臭氧层破坏
B. 形成酸雨
C. 产生温室效应
D. 产生光化学烟雾
E. 使大气混浊度增加，造成到达地面的太阳辐射大为减少

正确答案：D。产生光化学烟雾

解析：本题考查大气污染物对环境的主要影响。大气污染物碳氢化合物与氮氧化物可在日光紫外线的照射下，经过一系列的光化学反应生成的刺激性很强的浅蓝色烟雾，即光化学烟雾（D对ABCE错）。